按诊疗同意制度，无法取得患者意见又无家属或者关系人在场，或者遇到其他特殊情况时，处理措施是
A. 可以由经治医师决定施行
B. 可以由经治医师与其他医生商量后决定施行
C. 经治医师提出处置方案后，由无利害关系的人2人以上在场见证情况下施行
D. 经治医师提出处置方案，取得医疗机构负责人批准后施行
E. 经治医师决定，其他医护人员在场见证情况下施行

正确答案：D。经治医师提出处置方案，取得医疗机构负责人批准后施行